男，18岁。左大腿肿胀，疼痛3周，呈持续性，逐渐加剧，夜间尤重。查体：左大腿局部压痛，皮温高，静脉怒张。X线片显示左股骨下端骨质破坏，可见Codman三角。应首先考虑的诊断是
A. 骨肉瘤
B. 转移性骨肿瘤
C. 骨软骨瘤
D. 骨纤维发育不良
E. 骨巨细胞瘤

正确答案：A。骨肉瘤

解析：患者青少年（骨肉瘤好发人群）男性，左大腿肿胀，疼痛3周，呈持续性，逐渐加剧，夜间尤重（骨肉瘤常见症状）。查体：左大腿局部压痛，皮温高，静脉怒张（骨肉瘤常见体征）。X线片显示左股骨下端骨质破坏，可见Codman三角（骨肉瘤典型影像学表现）；结合患者临床表现及辅助检查初步诊断为：骨肉瘤（A对）。转移性骨肿瘤（B错）X线表现为：溶骨性、成骨性和混合型的骨质破坏，以溶骨性多见，病理性骨折多见（P779）。骨软骨瘤（C错）X线一般表现为在干骺端可见从皮质突向软组织的骨性突起，其皮质和松质骨以窄小或宽广的蒂与正常骨相连，彼此髓腔相通，皮质相连续，突起表面为软骨帽，不显影，厚薄不一，有时可呈不规则钙化影（P774-775）。骨纤维发育不良（D错）X线表现酷似“牧羊人手杖”（P780）。骨巨细胞瘤（E错）X线表现为肥皂泡样改变（P776）。